不要求进行无菌检查的剂型是哪种剂型
A. 注射剂
B. 吸入粉雾剂
C. 植入剂
D. 冲洗剂
E. 眼部手术用软膏剂

正确答案：B。吸入粉雾剂

解析：本题考查无菌制剂。吸入粉雾剂（B错，为本题正确答案）系指固体微粉化原料药物单独或与合适的载体混合后，以胶囊、泡囊或多剂量贮库形式，采用特制的干粉吸入装置，由患者主动吸入雾化药物至肺部的制剂。吸入气雾剂的质量检查包括递送剂量均一性、每瓶总揿次、微细粒子剂量、微生物限度、每揿主药含量、喷射速率、喷出总量、每揿喷量、粒度、装量、无菌。 除另有规定外，用于烧伤（除程度较轻的烧伤（Ⅰ度或浅Ⅱ度）外）、严重创伤或临床必须无菌的气雾剂，照无菌检查法（通则1101）检查，应符合规定。注射液（A对）系指原料药物或与适宜的辅料制成的供注入体内的无菌液体制剂。植入剂（C对）系指将药物与辅料制成的小块状或条状的供植入体内的无菌固体制剂。冲洗剂（D对）系指用于冲洗开放性伤口或体腔的无菌溶液剂。冲洗剂应无菌、无毒、无局部刺激性；开启后应立即使用，未用完的应弃去。眼部手术用软膏剂（E对）是指药物与适宜基质制成的供眼用的无菌软膏剂。用于眼外伤或术后的眼用制剂的成品必须经过严格灭菌，质量要求与注射剂相似。